当Km等于0.5[S]时，反应速度为最大速度的
A. 1/3
B. 1/2
C. 2/3
D. 3/5
E. 3/4

正确答案：C。2/3